当前，我国引起细菌性食物中毒的首位食品是
A. 豆类及其制品
B. 肉类及其制品
C. 蛋类及其制品
D. 奶类及其制品
E. 谷类及其制品

正确答案：B。肉类及其制品